患者，男，24岁。暴食后突然上腹剧痛，恶心，呕吐，发热。检查：腹部较软，上腹压痛，血清淀粉酶增高。其诊断是
A. 急性胃肠炎
B. 消化性溃疡急性穿孔
C. 胆囊炎
D. 急性胰腺炎
E. 心肌梗死

正确答案：D。急性胰腺炎

解析：患者青年男性，暴食（急性胰腺炎常见诱因）后突然上腹剧痛，恶心，呕吐，发热（急性胰腺炎常见症状），检查：腹部较软，上腹压痛，血清淀粉酶增高（急性胰腺炎时其值通常高于正常值3倍），综合患者的临床表现、辅助检查，考虑诊断是急性胰腺炎（D对）。急性胃肠炎（A错）是胃肠黏膜的急性炎症，临床表现主要为恶心、呕吐、腹痛、腹泻、发热，一般不会出现血清淀粉酶增高。消化性溃疡急性穿孔（B错）常突发剧烈刀割样疼痛，多有腹壁板样僵直，压痛、反跳痛等体征。胆囊炎（C错）常在饱餐、进食油腻食物后出现腹胀、腹痛，多为右上腹剧痛或绞痛。心肌梗死（E错）常见于老年人，多为心前区压榨样疼痛，伴大汗、恶心等症状。